人体氟代谢过程分为
A. 吸收
B. 分布
C. 排泄
D. A+B
E. A+B+C

正确答案：E。A+B+C

解析：氟的代谢过程可分为吸收、分布与排泄。掌握“人体氟摄入及代谢、氟防龋”知识点。